干姜、生姜同用的方剂是
A. 实脾散
B. 血府逐瘀汤
C. 当归六黄汤
D. 炙甘草汤
E. 大补阴丸

正确答案：A。实脾散

解析：实脾苓术与木瓜，甘草木香大腹加，草果姜附兼厚朴，虚寒阴水效堪夸。实脾散的功用为温阳健脾，行气利水，主治脾肾阳虚，水气内停之阴水。身半以下肿甚，手足不温，口中不渴，胸腹胀满。大便溏薄，舌苔白腻，脉沉弦而迟（A对）。血府逐瘀汤（B错），血府当归生地桃，红花枳壳膝芎饶。柴胡赤芍甘桔梗，血化下行不作痨。当归六黄汤（C错），当归六黄二地黄，芩连芪柏共煎尝，滋阴泻火兼固表，阴虚火旺盗汗良。炙甘草汤（D错）炙甘草汤参姜桂，麦冬生地与麻仁，大枣阿胶加酒服，虚劳肺痿效如神。大补阴丸（E错），大补阴丸知柏黄，龟板脊髓蜜成方，咳嗽咯血骨蒸热，阴虚火旺制亢阳。